严重心功能不全患者不宜使用的降血糖药是
A. 双胍类
B. 噻唑烷二酮类
C. 磺脲类
D. 格列奈类
E. α葡萄糖苷酶抑制剂

正确答案：B。噻唑烷二酮类

解析：噻唑烷二酮类（B错，为本题正确答案）主要通过激活过氧化物酶体增殖性物激活受体γ起作用，增加靶组织对胰岛素作用的敏感性而降低血糖，其可增加血容量，心功能不全患者不宜使用。双胍类（P738）（A对）不良反应主要为胃肠道反应，对心功能无影响。目前尚无资料证实磺脲类（P737）（C对）药物会增加T2DM患者心血管疾病的发病率和病死率。格列奈类（P737）（D对）为非磺酰脲类促胰岛素分泌剂，主要用于控制餐后高血糖，也有一定降低空腹血糖的作用，其对心功能亦无影响。α葡萄糖苷酶抑制剂（P739）（E对）可抑制小肠黏膜刷状缘的a-葡萄糖苷酶从而延迟碳水化合物吸收，降低餐后高血糖，其不良反应为胃肠道反应，对心功能无影响。